女，70岁。因高血压冠心病口服阿司匹林，一天前因胸闷，心前疼痛就诊，检查肌钙蛋白明显升高。原因可能是
A. 心肌梗死
B. 胃溃疡
C. 肝脏占位
D. 药物副作用
E. 深静脉血栓形成

正确答案：A。心肌梗死

解析：患者老年女性，有高血压冠心病病史，胸闷、胸痛，肌钙蛋白（心肌梗死特异性标志物）明显升高，原因可能是心肌梗死（A对）。胃溃疡（P369）（B错）常见症状为上腹部疼痛或不适，一般肌钙蛋白不升高。肝脏占位（C错）指的是肝脏正常影像检查上，肝实质内出现异常回声区或密度区，可能的病因有肝癌，肝囊肿等，可伴有肝区疼痛，与本例明显不符。阿司匹林最常见的副作用为消化道反应，如上腹不适、恶心、呕吐等。不会出现胸闷、胸痛等症状（D错）。深静脉血栓形成（八版外科学P518）（E错）常表现为一侧肢体胀痛、浅静脉扩张等，若血栓脱落造成肺动脉栓塞，可引起胸痛症状，通常为D-二聚体升高，而不会引起肌钙蛋白升高。